绿色、橙黄色蔬菜较浅色蔬菜富含
A. 纤维素
B. 胡萝卜素
C. 维生素B₁
D. 蛋白质
E. 淀粉

正确答案：B。胡萝卜素